适用于上颌前磨牙、磨牙拔除术的腭侧麻醉
A. 上牙槽后神经阻滞麻醉
B. 眶下神经阻滞麻醉
C. 腭前神经阻滞麻醉
D. 鼻腭神经阻滞麻醉
E. 下牙槽神经阻滞麻醉

正确答案：C。腭前神经阻滞麻醉

解析：腭前神经阻滞麻醉：将麻药注射入腭大孔或其附近以麻醉腭前神经，故又称为腭大孔麻醉：本法适用于上颌前磨牙、磨牙拔除术的腭侧麻醉。掌握“颌面部常用局麻法及牙拔除的麻醉选择”知识点。